在生产过程中形成的呼吸性粉尘是指
A. 能随呼吸进入人体并沉积于呼吸道的粉尘
B. 分散度较小的粉尘
C. 直径小于5μm的粉尘
D. 分散度较大的粉尘
E. 直径小于15μm的粉尘

正确答案：C。直径小于5μm的粉尘

解析：呼吸性粉尘是指AED在5μm以下的粒子（C对）。能随呼吸进入人体并沉积于呼吸道（A错）、直径小于15μm的粉尘（E错）为可吸入性粉尘（P303）。呼吸性粉尘的界定与粉尘动力学直径有关，而与分散度无关（BD错）；分散度是用粉尘颗粒大小的组成描述某一生产中物质被粉碎的程度，分散度越高，粉尘的颗粒越细小，被吸入机会越多。